急性硬脑膜外血肿最常合并的颅脑损伤是
A. 脑水肿
B. 颅骨骨折
C. 脑积水
D. 脑挫伤
E. 脑干损伤

正确答案：B。颅骨骨折

解析：急性硬膜外血肿最常合并的损伤是颅骨骨折（B对）。硬脑膜外血肿的形成与颅骨损伤有密切关系，骨折或颅骨的短暂变形，撕破位于骨沟内的硬脑膜动脉（以脑膜中动脉为主）或静脉窦引起出血形成血肿，或骨折处的板障出血形成血肿。脑水肿（A错）、脑积水（C错）、脑挫伤（D错）和脑干损伤（E错）亦是急性硬膜外血肿的并发症，但均不如颅骨骨折常见。